下列叙述，错误的是
A. 内生肌酐消除率是测定肾功能的可靠方法
B. 内生肌酐消除率正常时说明此人肾功能正常
C. 内生肌酐消除低于正常值25%时，治疗方法要改变
D. 药物由肾脏排出大于50%者，均对肾脏造成损害
E. 药物由肾脏排出少于15%者，一般认为对肾脏无害

正确答案：D。药物由肾脏排出大于50%者，均对肾脏造成损害